下列哪项不是脾的生理功能
A. 水谷的受纳和腐熟
B. 水谷精微的转输
C. 水液的吸收和转输
D. 脏器位置的维系
E. 血液的统摄

正确答案：A。水谷的受纳和腐熟

解析：本题考查脾胃的生理功能，属于理解记忆内容。水谷的受纳和腐熟是胃的主要生理功能（A错，为本题正确答案）。脾主运化，是指脾具有把饮食水谷转化为水谷精微（即谷精）和津液（即水精），并把水谷精微和津液吸收、转输到全身各脏腑的生理功能（BC对）， 脾气主升，脾气主升，是指脾气的运动特点，以上升为主，具体表现为升清和升举内脏两方面生理作用（D对），脾主统血，是指脾气有统摄、控制血液在脉中正常运行而不逸出脉外的功能（E对）。